智力包括一个人的
A. 观察力
B. 注意力
C. 想象力
D. 思维力
E. 以上等能力的综合

正确答案：E。以上等能力的综合

解析：本题考查心理健康概述。智力包括一个人的观察力、注意力、想象力、思维力等能力的综合（E对）。